胶囊剂系指原料药物或与适宜辅料填充于空心胶囊或密封于软质囊材中制成的固体制剂。下列关于胶囊剂的说法，错误的是
A. 胶囊剂可制成定时释放药物的制剂
B. 胶囊剂可外用于直肠、阴道等部位
C. 软胶囊可用压制法制备
D. 硬胶囊的填充物可以是液体药物
E. 缓释胶囊是指可以缓慢地恒速释放药物

正确答案：E。缓释胶囊是指可以缓慢地恒速释放药物

解析：本题考查胶囊剂的特点与分类。缓释胶囊是指可以缓慢地恒速释放药物的胶囊剂（E错，为本题正确答）描述错误。缓释胶囊：系指在规定释放介质中，按要求缓慢地非恒速释放药物的胶囊剂。胶囊剂的特点：①能掩盖药物的不良气味，减小药物的刺激性，便于服用。②与片剂、丸剂比较，在胃肠道中崩解、溶出快，吸收好，起效快，生物利用度高。③药物充填于胶囊中，与光线、空气和湿气隔绝，可提高药物稳定性。④胶囊剂可制成定时释放药物的制剂（A对）。分类：胶囊剂可分为硬胶囊、软胶囊（胶丸）、缓释胶囊、控释胶囊和肠溶胶囊，主要供口服用。胶囊剂可外用于直肠、阴道等部位（B对）。软胶囊系指将一定量的液体原料药物直接包封，或将固体原料药物溶解或分散在适宜的辅料中制备成溶液、混悬液、乳状液或半固体，密封于软质囊材中的胶囊剂。软胶囊又称胶丸，可用滴制法或压制法制备（C对）。硬胶囊（通称为胶囊）系指采用适宜的制剂技术，将原料药物或加适宜辅料制成的均匀粉末、颗粒、小片、小丸、半固体或液体（D对）等，充填于空心胶囊中的胶囊剂。